机体组织细胞对毒作用反应特点不包括
A. 具有特异的靶器官和靶部位
B. 病变性质相同
C. 病变性质各有不同
D. 病变程度存在剂量-效应关系

正确答案：B。病变性质相同

解析：本题考查机体组织细胞对毒作用反应特点。机体组织细胞对毒作用反应特点包括：具有特异的靶器官和靶部位（A对）；病变性质各有不同（C对）；病变程度存在剂量-效应关系（D对）。病变性质相同（B错，为本题正确答案）不是机体组织细胞对毒作用反应特点。